胆红素的组成由
A. 3个次甲基桥连接的3个亚氨基
B. 3个次甲基桥连接的3个亚氨基
C. 3个次甲基桥连接的4个吡咯环
D. 4个次甲基桥连接的3个亚氨基
E. 4个次甲基桥连接的3个吡咯环

正确答案：C。3个次甲基桥连接的4个吡咯环

解析：胆红素是由3个次甲基桥连接的4个吡咯环组成，分子量585。虽然胆红素分子中含有2个羟基或酮基、4个亚氨基和2个丙酸基等亲水基团，但由于这些基团形成6个分子内氢键，使胆红素分子具有亲脂疏水的性质，易自由透过细胞膜进入血液。掌握“胆色素代谢”知识点。